慢性肺源性心脏病的主要发病机制是
A. 血液粘度增高
B. 肺小血管管壁增厚、管腔狭窄
C. 缺氧和酸中毒使肺小动脉收缩
D. 用力吸气使胸内压降低增加右心收缩负荷
E. 用力呼气使胸内压升高减弱右心舒张功能

正确答案：C。缺氧和酸中毒使肺小动脉收缩

解析：慢性肺源性心脏病的主要发病机制是缺氧和酸中毒使肺小动脉收缩（C对）。